天仙子的内服用量是
A. 0.01～0.03g
B. 0.06～0.6g
C. 0.8～1.2g
D. 1.5～2.0g
E. 2.0～3.0g

正确答案：B。0.06～0.6g

解析：本题考查的是天仙子的用法用量。天仙子的内服用量是0.06～0.6g（B对）。生天仙子的用法用量：内服，0.06～0.6g。注意事项：心脏病、心动过速、青光眼患者及孕妇禁用。